糖的有氧氧化第三阶段指
A. 在胞液中进行
B. 氧化脱羧生成乙酰CoA
C. 丙酮酸由胞液进入线粒体
D. 胞液经糖酵解途径分解成丙酮酸
E. 线粒体内，乙酰CoA进入三羧酸循环被彻底氧化

正确答案：E。线粒体内，乙酰CoA进入三羧酸循环被彻底氧化

解析：糖的有氧氧化可分为三个阶段。第一阶段：葡萄糖在胞液经糖酵解途径分解成丙酮酸。第二阶段：丙酮酸由胞液进入线粒体，氧化脱羧生成乙酰CoA。第三阶段：在线粒体内，乙酰CoA进入三羧酸循环被彻底氧化。掌握“糖分解”知识点。